女性病人，28岁。妊娠后期出现进行性背痛，下肢乏力，食欲减退.查体见第7胸椎轻度后突，有叩痛，X线片示第6、7胸椎间隙变窄，椎旁软组织阴影膨隆，血沉60mm/h。最可能的诊断是
A. 胸椎转移癌
B. 胸椎结核
C. 胸椎血管瘤
D. 化脓性脊椎炎
E. 胸椎间盘脱出

正确答案：B。胸椎结核

解析：本例患者为妊娠期女性，有进行性背痛，下肢乏力，食欲减退的病史，体格检查发现第7胸椎轻度后突且伴有叩击痛，X线片示第6、7胸椎间隙变窄，椎旁软组织阴影膨隆是椎间隙破坏引起的，血沉加快为炎症表现，最可能的诊断是胸椎结核（B对）。胸椎转移癌（A错）好发于乳腺癌、肺癌等病人，临床表现视原发病灶而定，X线检查胸椎椎间隙一般正常且一般无椎旁软组织肿块影。胸椎血管瘤（C错）是一种良性肿瘤，部分患者因为血管瘤的浸润可有腰痛、活动受限等症状，X线检查胸椎椎间隙正常。化脓性脊椎炎（D错）好发于成人，以腰椎最为多见，起病急，有高热及明显疼痛、进展很快，早期X线检查往往无异常发现，晚期可出现椎体内虫蚀状破坏等征象。胸椎间盘脱出（E错）在临床上较少见，症状与体征不典型，X线检查早期无明显异常，血沉多正常。